大豆中含量最高的营养成分是
A. 脂肪
B. 蛋白质
C. 碳水化合物
D. 维生素
E. 无机盐

正确答案：B。蛋白质